服用后导致低血糖的药有
A. 格列本脲
B. 瑞格列奈
C. 格列吡嗪
D. 西格列汀
E. 维格列汀

正确答案：A、B、C、E。格列本脲；瑞格列奈；格列吡嗪；维格列汀

解析：本题考查降糖药的不良反应。服用后导致低血糖的药有：格列本脲（A对）、瑞格列奈（B对）、格列吡嗪（C对）、维格列汀（E对）。西格列汀（D错）属于二肽基肽酶-4抑制剂类降糖药，不具有低血糖类不良反应。